患者，男，60岁。因上臂出现湿疹到药店购药，药师应推荐的药品是
A. 利巴韦林软膏
B. 特比萘芬乳膏
C. 10%樟脑软膏
D. 氢化可的松软膏
E. 红霉素软膏

正确答案：D。氢化可的松软膏

解析：本题考查湿疹的用药。氢化可的松软膏（D对）属于糖皮质激素类软膏，用于治疗亚急性、慢性湿疹，除此外还可用焦油类制剂或免疫调节剂。继发感染者加用抗生素制剂。急性湿疹局部以生理盐水、3%硼酸或1：（2000～10000）高锰酸钾溶液冲洗、湿敷。特比萘芬乳膏（B错）可用于治疗水疱型足癣。利巴韦林软膏（A错）是抗病毒药，用于单纯疱疹病毒性角膜炎。10%樟脑软膏（C错）用于治疗轻度冻疮。红霉素软膏（E错）用于严重冻疮合并严重感染者。